能截疟的是
A. 常山
B. 瓜蒂
C. 藜芦
D. 硫黄
E. 轻粉

正确答案：A。常山

解析：本题考查的是常山的功效。能截疟的是常山（A对）。常山：【功效】涌吐痰饮，截疟。瓜蒂（B错）：【功效】内服涌吐热痰、宿食；外用研末吹鼻，引去湿热。藜芦（C错）：【功效】涌吐风痰，杀虫疗癣。硫黄（D错）：【功效】外用解毒杀虫止痒，内服补火助阳通便。轻粉（E错）：【功效】外用杀虫、攻毒、敛疮；内服祛痰消积，逐水通便。